以下哪种情况不会影响面部外形的对称性
A. 偏侧咀嚼
B. 牙列缺损
C. 牙列缺失
D. 后牙早失
E. 单个牙牙体缺损

正确答案：E。单个牙牙体缺损

解析：本题考查影响面部外形对称性的情况。单个牙牙体缺损（E错，为本题的正确答案）对咀嚼功能的影响较小，咀嚼功能没有明显降低，患者也不会因单个牙牙体缺损而偏侧咀嚼，因此不会影响到面部外形的对称性。长期偏侧咀嚼（A对）后，咀嚼侧咀嚼肌发达，不咀嚼侧咀嚼肌得不到锻炼会逐渐萎缩，导致面容不对称。牙列缺损（B对）的患者，因患侧失去牙齿，咀嚼效率降低，长期以往患者则会偏侧咀嚼，影响面部对称性。牙列缺失（C对）对患者的面容改变、咀嚼功能产生重大影响，牙槽骨吸收，上下颌骨逐渐失去原有的形状和大小。后牙早失（D对）以后，邻牙向缺隙部位倾斜，对颌牙伸长，咀嚼效率降低，长期也会导致患者偏侧咀嚼，影响面部外形的对称性。